肺癌发生率一般较高发生在
A. 乡村居民中
B. 城市居民中
C. 燃天然气的居民中
D. 燃煤气的居民中
E. 空气中苯并（a）芘浓度较高的居民中

正确答案：E。空气中苯并（a）芘浓度较高的居民中

解析：本题考查肺癌的高发人群。肺癌发生率一般较高发生在空气中苯并（a）芘浓度较高的居民中（E对ABCD错）。